中年人加强自我心理保健的方法错误
A. 重视对自身心理健康的监察
B. 向往未来，做好长期打算
C. 积极合理地应对各种生活压力
D. 努力加强自我心理保健
E. 不需要心理医生

正确答案：E。不需要心理医生

解析：中年人心理健康常见问题的对策：重视对自身心理健康的监察；积极合理地应对各种生活压力；努力加强自我心理保健。掌握“不同年龄阶段心理卫生”知识点。